子宫颈原位癌与不典型增生的鉴别主要在于原位癌
A. 细胞排列极性消失
B. 细胞具有异型性
C. 细胞增生活跃，层数增多
D. 增生的细胞表层角化不全
E. 累及上皮全层

正确答案：E。累及上皮全层

解析：子宫颈原位癌（八版病理学P285）是指异型增生的细胞累及子宫颈黏膜上皮全层（E对），但病变局限于上皮层内，未突破基底膜。不典型增生（子宫颈上皮异型增生）指子宫颈上皮部分被不同程度异型性的细胞所取代。表现为细胞大小形态不一，核增大深染，核质比例增大，核分裂象增多，细胞极性紊乱。